我国社区卫生服务体系建设内容不包括
A. 坚持公益性质，完善社区卫生服务功能
B. 建设大型综合性医院
C. 加强社区卫生服务队伍建设与完善社区卫生服务运行机制
D. 建立社区卫生服务机构与预防保健机构、医院合理的分工协作关系
E. 坚持政府主导、鼓励社会参与，建立健全社会卫生服务网络

正确答案：B。建设大型综合性医院

解析：社区卫生服务体系建设要坚持社区卫生服务的公益性质，注重卫生服务的公平、效率和可及性（A对）；坚持政府主导，鼓励社会参与，多渠道发展社区卫生服务（E对）。我国目前卫生资源布局和结构不尽合理，资源过分向大医院集中，应充分利用社区已有的各种资源，避免重复建设，不应再建设大型综合性医院（B错，为本题正确答案）。社区卫生服务融预防、医疗、保健康复、健康教育、计划生育技术服务等为一体，需建立社区卫生服务机构与预防保健机构、医院合理的分工协作关系（D对）。